感染肺脓肿形成单个空洞的是
A. 结核菌
B. 真菌
C. 肺炎链球菌
D. 金黄色葡萄球菌
E. 厌氧菌

正确答案：E。厌氧菌

解析：肺脓肿根据感染途径可分为吸入性肺脓肿、继发性肺脓肿、血源性肺脓肿。感染肺脓肿形成单个空洞的常为吸入性肺脓肿，其致病菌常为厌氧菌（E对）；金黄色葡萄球菌常为继发性肺脓肿和血源性肺脓肿的致病菌（D错）。结核杆菌（A错）常为空洞性肺结核的致病菌；肺炎链球菌（C错）常为细菌性肺炎的致病菌；真菌（B错）常与真菌感染伴空洞形成有关。